对手术耐受力最差的心脏病类型是
A. 急性心肌炎
B. 房室传导阻滞
C. 非紫绀型先天性心脏病
D. 风湿性心脏病
E. 高血压性心脏病

正确答案：A。急性心肌炎

解析：心脏病患者的手术耐力分为三类（五版外科学P154）：①手术耐力良好者：非紫绀型先心病（C错）、风心病（D错）、高心病（E错）、心律正常无心衰趋势者；②手术耐力较差者：冠心病、房室传导阻滞（B错）；③手术耐力很差者：急性心肌炎（A对）、急性心梗、心力衰竭。